患者男性，25岁，右下第三磨牙Ⅱ类近中中位阻生，存在邻牙阻力，劈开时松动，冠未劈开，最佳手术方案是
A. 直接挺出
B. 增隙后挺出
C. 继续劈冠
D. 涡轮钻磨除近中牙冠
E. 切开黏骨膜去骨后拔除

正确答案：D。涡轮钻磨除近中牙冠

解析：本题考查牙拔除术的相关内容。患者右下第三磨牙Ⅱ类近中中位阻生，存在邻牙阻力，劈开时松动，冠未劈开，最佳手术方案是涡轮钻磨除近中牙冠（D对）。该牙冠脱位时受到近中邻牙的阻碍，近中阻生齿常通过劈冠解除邻牙阻力。但是如术中牙已松动，再使用劈开法常常失败（C错），且易发生牙移位或舌侧骨板骨折，此时应直接磨除近中牙冠。由于存在邻牙阻力，故不能直接挺出（A错）。由于该牙冠脱位时受到近中邻牙的阻碍，所以增隙后挺出（B错）或切开黏骨膜去骨后拔除（E错）行不通。